牙源性钙化上皮瘤组织内常见一种特征性物质为
A. 软骨样物质
B. 黏液样物质
C. 淀粉样物质
D. 菌丝样物质
E. 脓液样物质

正确答案：C。淀粉样物质

解析：牙源性钙化上皮瘤组织内常见一种特征性圆形嗜酸性均质物质，分布于细胞之间，特殊染色（如硫代黄色T、刚果红等）证实这种物质为淀粉样物质。掌握“牙源性钙化上皮、囊性瘤”知识点。